对于含酚工业废水的处理，一般可采用
A. 混凝沉淀
B. 氧化还原
C. 萃取处理
D. 离子交换
E. 活性污泥

正确答案：B。氧化还原

解析：本题考查工业废水处理的相关内容。氧化还原是利用某些氧化
剂或还原剂将废水中的有害物质转变成无毒或微毒的新化学物质，而达到处理废水的目的。电解氧化还原法（B对ACDE错），借助于电流通过电解液（废水）引起的氧化还原反应，去除废水中的铬、氰、酚等有害物质。